化脓菌侵入单个毛囊及周围组织引起的急性化脓性炎症属
A. 疮
B. 痈
C. 疖
D. 发
E. 疽

正确答案：C。疖

解析：疖是化脓菌侵入单个毛囊及周围组织引起的急性化脓性炎症（C对）。疮疡（A错）是各种致病因素侵袭人体后引起的一切体表化脓感染性疾病的总称，包括急性和慢性两大类。痈（B错）为相邻近的多个毛囊及毛囊周围急性化脓性炎症。发（D错）一般是来势迅猛而病变范围大于痈的外疡，相当于西医的蜂窝织炎。疽（E错）是局部皮肤肿胀坚硬而皮色不变的毒疮，分有头疽和无头疽。